心理活动或意识对一定对象的指向或集中的现象称为
A. 注意
B. 人格
C. 记忆
D. 情感
E. 想象

正确答案：A。注意

解析：注意是心理活动对一定对象的指向和集中（A对）。注意本身不是一种独立的心理活动，它不能单独进行或完成，它是心理活动的一种属性或特性，指向性和集中性都是注意的基本特征。人格（B错）是人稳定的心理特征的综合。记忆（C错）是指在头脑中积累和保持个体经验的心理过程。从信息加工的观点看，记忆是人脑对外界输人的信息进行编码、储存和提取的过程。情感（D错）是指人们对客观事物是否符合自身需要的态度的体验。想象（E错）是对大脑中已有表象进行加工改造，形成新形象的过程。